对高血压肾病患者，在应用血管紧张素转换酶抑制剂的基础上联合应用的药物是
A. 阿司匹林
B. 叶酸
C. 阿托伐他汀
D. 呋塞米
E. 布地奈德

正确答案：D。呋塞米

解析：本题考查药物的联合应用。对高血压肾病患者，在应用血管紧张素转换酶抑制剂的基础上联合应用的药物是呋塞米（D对）。高血压合并肾病，（包括糖尿病肾病）应严格控制血压（<130/80mmHg），当尿蛋白>1g/d时，血压目标应<125/75mmHg；并尽可能将尿蛋白降至正常。一般需用一种以上、甚至三种药物方能使血压控制达标，首选ACEI/ARB，常与CCB、小剂量利尿剂联合应用。小剂量（75mg/d）阿司匹林（A错）有抗血栓作用，主要用于预防手术后血栓形成及心肌梗死。叶酸（B错）用于合并同型半胱氨基酸血症的高血压患者。阿托伐他汀（C错）为调血脂药，临床用于调血脂、肾病综合征、血管成形术后再狭窄及预防心脑血管急性事件等。布地奈德（E错）为糖皮质激素，用于哮喘的治疗。